易阻遏气机的邪气是
A. 风
B. 寒
C. 湿
D. 燥
E. 火

正确答案：C。湿

解析：本题主要考察六淫各自的性质和致病特征。湿，为阴邪，易损伤阳气，阻遏气机（C对）；湿性重浊、黏腻；湿性趋下，易袭阴位。风为阳邪，轻扬开泄，易袭阳位；风性善行而数变；风性主动；风为百病之长（A错）。寒为阴邪，易伤阳气；寒性凝滞；寒性收引（B错）。燥性干涩，易伤津液；燥易伤肺（D错）。火热为阳邪，其性炎上；火热易扰神；火热易伤津耗气；火热易生风动血；火邪易致疮痈（E错）。